既清热泻火，又利尿通便的成药是
A. 芩连片
B. 导赤丸
C. 金银花露
D. 小儿感冒颗粒
E. 小儿热速清口服液

正确答案：B。导赤丸

解析：本题考查的是导赤丸的功能。既清热泻火，又利尿通便的成药是导赤丸（B对）。导赤丸：【功能】清热泻火，利尿通便。芩连片（A错）：【功能】清热解毒，消肿止痛。小儿热速清口服液（E错）：【功能】清热解毒，泻火利咽。金银花露（C错）与小儿感冒颗粒（D错）的功能，2022年考试指南未明确说明。